排毒系数表示
A. 污染源排放的污染物对人群危害程度的一种相对指标
B. 污染源排放的污染物对环境危害程度的一种相对指标
C. 污染源排放的污染物对生物危害程度的一种相对指标
D. 污染源排放的污染物对动植物危害程度的一种相对指标
E. 污染源排放的污染物对微生物危害程度的一种相对指标

正确答案：A。污染源排放的污染物对人群危害程度的一种相对指标